严重者可将牙根分裂为二，形成一个额外根
A. 畸形舌侧窝
B. 畸形唇面
C. 畸形根面沟
D. 畸形舌侧尖
E. 牙中牙

正确答案：C。畸形根面沟

解析：畸形根面沟：可与畸形舌侧窝同时出现，为一条纵形沟裂，向舌侧越过舌隆突，并向根方延伸；严重者可达根尖部，甚至有的将牙根分裂为二，形成一个额外根。掌握“牙内陷”知识点。